小儿营养不良是指体重低于正常值的
A. 40%
B. 30%
C. 20%
D. 15%
E. 10%

正确答案：D。15%

解析：小儿营养不良一般指体重低于正常值的15%，分为三度：体重低于正常值的15%～25%为轻度营养不良，体重低于正常值的25%～40%为中度营养不良，体重低于正常值的40%为重度营养不良，故小儿营养不良是指体重低于正常值的15%（D对）。40%（A错）为重度营养不良与中度营养不良的分界值。30%（B错）属于中度营养不良。20%（C错）属于轻度营养不良。体重低于正常值的10%（E错）需注意营养不良的可能，密切监测体重。